影响N-亚硝基化合物致癌作用的因素有
A. 化合物的种类与结构
B. 食物的加工与烹调方法
C. 化合物的剂量与摄入途径
D. 动物的种类
E. 以上都是

正确答案：E。以上都是